大补阴丸中既能填精补阴，又能制约黄柏苦燥的药物是
A. 熟地黄
B. 龟板
C. 知母
D. 猪脊髓
E. 山茱萸

正确答案：D。猪脊髓

解析：本题考查大补阴丸的方解。大补阴丸中熟地龟板的配合，作为填精补髓，滋肾填精的主要结构，没有提到可以制约黄柏苦燥（AB错）。黄柏、知母是一组滋阴降火药，知母可以滋阴，能够清热。黄柏和知母相配，擅长于降虚火，退虚热（C错）。用猪脊髓，原方用做赋型剂，猪脊髓是血肉有情之品，也能以髓补髓，增强填精补髓的功效，缓和黄柏知母这类药物的苦寒之性（D对）。山茱萸不是大补阴丸的组成药物（E错）。